患者，女，30岁。左手背不慎被热汤灼伤，皮肤色红肿胀，疼痛剧烈，间有大小不等水疱，基底部潮红。其烧伤深度为
A. I度
B. 浅Ⅱ度
C. 深Ⅱ度
D. 浅Ⅲ度
E. 深Ⅲ度

正确答案：B。浅Ⅱ度

解析：出现水疱而非红斑，不属于Ⅰ度（A错）。出现水疱，疼痛剧烈，符合浅Ⅱ度表现（B对）。虽有水疱，有痛觉，深Ⅱ度失去痛觉（C错）。Ⅲ度表现为焦痂，不见正常皮肤（D错）。无痛觉消失、坚硬如皮革样的典型症状（E错）。